某女，38岁。近日因肝气郁结、肝脾不和，遂致胁痛、痢疾，症见脘腹胁痛、热厥手足不温、泻痢下重。宜选用的成药是
A. 四逆散
B. 左金丸
C. 逍遥丸
D. 越鞠丸
E. 气滞胃痛颗粒

正确答案：A。四逆散

解析：本题考查的是四逆散的主治。近日因肝气郁结、肝脾不和，遂致胁痛、痢疾，症见脘腹胁痛、热厥手足不温、泻痢下重。宜选用的成药是四逆散（A对）。四逆散：【主治】肝气郁结、肝脾不和所致的胁痛、痢疾，症见脘腹胁痛、热厥手足不温、泻痢下重。左金丸（B错）：【主治】肝火犯胃，脘胁疼痛，口苦嘈杂，呕吐酸水，不喜热饮。逍遥丸（C错）：【主治】肝郁脾虚所致的郁闷不舒、胸胁胀痛、头晕目眩、食欲减退、月经不调。越鞠丸（D错）：【主治】瘀热痰湿内生所致的脾胃气郁，症见胸脘痞闷、腹中胀满、饮食停滞、嗳气吞酸。气滞胃痛颗粒（E错）：【主治】肝郁气滞，胸痞胀满，胃脘疼痛。